镫骨底封闭
A. 颅骨
B. 第二鼓膜
C. 蜗孔
D. 前庭窗
E. 基底膜

正确答案：D。前庭窗

解析：第二鼓膜（B错）封闭蜗窗。前庭窗（D对）由镫骨底及其周缘的韧带封闭。基底膜（E错）和骨螺旋板组成鼓室下壁。